体外试验方法常用
A. 游离器官
B. 原代培养细胞
C. 细胞器
D. CHO，V79
E. 以上都是

正确答案：E。以上都是